因含皂苷，能促进呼吸道的分泌功能，呈现祛痰作用的中药是
A. 桔梗
B. 皂荚
C. 半夏
D. 款冬花
E. 川贝母

正确答案：A、B、E。桔梗；皂荚；川贝母

解析：本题考查中药化学成分与药理作用。因含皂苷，能促进呼吸道的分泌功能，呈现祛痰作用的中药是桔梗（A对）、皂荚（B对）、川贝母（E对）。祛痰药：桔梗、川贝母、前胡、紫菀、皂荚、天南星、款冬花、蔊菜、满山红等的煎剂或流浸膏均有祛痰作用，能促进呼吸道的分泌功能，一般在给药后1小时作用达到高峰，其中以桔梗、前胡、皂荚的作用最强，款冬花的作用较弱。与化痰止咳平喘方药相关的药理作用为祛痰、镇咳、平喘作用。主要化学物质基础有皂苷类成分、挥发油和生物碱等。桔梗主要化学成分为皂苷。皂荚主要化学成分为三萜皂苷、鞣质。川贝母主要化学成分为生物碱、糖类、甾醇类、内酯香豆素类、挥发油等成分。半夏（C错）含半夏蛋白、多糖等。半夏味辛，性温，有毒，归脾、胃、肺经。具有燥湿化痰、降逆止呕、消痞散结之功效。款冬花（D错）主要化学成分为含款冬二醇、山金车二醇、款冬花碱、克氏千里光碱、金丝桃苷等。